肺主一身之气体现于
A. 精气
B. 元气
C. 宗气
D. 清气
E. 营气

正确答案：C。宗气

解析：肺主一身之气是指肺具有主司一身之气的生成和运行的作用。具体体现于：生成宗气-肺主气司呼吸，由肺吸入的自然界清气与脾胃运化的水谷之精所化生的水谷之气在胸中相结合而成宗气，宗气为后天之气，关系着一身之气的盛衰；调节全身气机-通过肺有节律的呼吸，而对全身之气的升降出入起着重要调节作用（C对）。